上消化道出血时可见
A. 水样便
B. 米泔样便
C. 鲜血便
D. 柏油样便
E. 灰白色便

正确答案：D。柏油样便

解析：上消化道出血时可见柏油样便（D对）。水样便见于各种感染性和非感染性腹泻（A错）。米泔样便见于重症霍乱、副霍乱患者（B错）。鲜血便见于直肠息肉、直肠癌、肛裂及痔疮等（C错）。灰白色便见于胆管阻塞患者（E错）。